患者男性，32岁，6天前感冒后出现左下后牙区胀痛，进食、吞咽时加重。昨日起出现局部自发性跳痛，张口受限，低热，头痛，检查可见：左下颌角区颊部稍肿胀，无压痛，张口度两指，左下第三磨牙近中阻生牙龈红肿充血，挤压可见远中盲袋内少量脓液溢出，颊侧前庭沟丰满、充血，压痛明显、叩诊（-），无松动，咽侧壁稍充血，无压痛。此患者经治疗后，病情好转，仅有远中牙龈轻度压痛，此时应
A. 龈切消除盲袋
B. 局部冲洗上药
C. 拔除患牙
D. 口服抗生素继续消炎
E. 锻炼身体提高抵抗力

正确答案：C。拔除患牙

解析：本题考查智齿冠周炎的治疗。智齿近中阻生引发智齿冠周炎，待炎症控制后，应尽早拔除患牙（C对），避免复发。对于有足够萌出位置的智齿，可龈切消除盲袋（A错）。局部冲洗上药为智齿冠周炎急性期的主要处理措施（B错）。口服消炎药是智齿冠周炎急性期的辅助治疗措施（D错）。锻炼身体提高免疫力，对于预防智齿冠周炎的复发收效甚微（E错）。